具有固表止汗，益气除热功效的药物是
A. 麻黄根
B. 浮小麦
C. 麻黄
D. 五味子
E. 山茱萸

正确答案：B。浮小麦

解析：该题考查浮小麦的功效，属记忆内容。浮小麦甘、凉。归心经。具有固表止汗，益气，除热的功效。（B对ACDE错）。